被称为“封藏之本”的是
A. 心
B. 脾
C. 肺
D. 肝
E. 肾

正确答案：E。肾

解析：肾主藏精，精藏于肾而不无故流失，故为“封藏之本”（E对）。心（A错）为“君主之官”、“生之本”“五脏六腑之大主”。脾（B错）为“后天之本”、“气血生化之源”。肺（C错）为“娇脏”、“华盖”、“相傅之官”。肝（D错）为“将军之官”、“罢极之本”。